以下诸项不符合儿童多动症的临床特征的是
A. 冲动任性
B. 女性多于男性
C. 智力正常或基本正常
D. 注意力不集中
E. 动作过多

正确答案：B。女性多于男性

解析：注意缺陷多动障碍又称儿童多动综合征，是儿童时期最常见的一种神经行为障碍，临床以与年龄不相称的注意力不集中（D对），不分场合的动作过多（E对），情绪冲动（A对），可伴有认知障碍和学习困难，智力正常或基本正常为特征（C对）。好发年龄为6～14岁。男孩发病较多，男：女为（4～9）：1（B错，为本题正确答案）。